下列不支持急性白血病血象变化的是
A. 网织红细胞数增高
B. 白细胞数增高
C. 白细胞数正常
D. 白细胞数减低
E. 血小板数减低

正确答案：A。网织红细胞数增高